易被挤压嵌入枕骨大孔的是
A. 大脑枕叶
B. 小脑蚓
C. 小脑半球
D. 小脑扁桃体
E. 以上都不可能

正确答案：D。小脑扁桃体

解析：在小脑半球下面的前内侧，各有一突出的结构称为小脑扁桃体，小脑扁桃体紧邻延髓和枕骨大孔的两侧，当颅内压突然增高时，小脑扁桃体（D对）易被挤压嵌入枕骨大孔，形成枕骨大孔疝或称小脑扁桃体疝，压迫延髓内的呼吸中枢和心血管运动中枢，危及生命。